对于恒牙釉质浅龋（未形成龋洞）可以使用的保守治疗术是
A. 药物治疗
B. 银汞充填
C. 根管治疗
D. 牙髓治疗
E. 塑化治疗

正确答案：A。药物治疗

解析：药物治疗的适应症为恒牙釉质早期龋，尚未形成龋洞者，特别是位于易清洁的平滑面，如颊、舌面龋。掌握“龋病的治疗原则与非手术治疗方法”知识点。